哪种情志异常易使肝的疏泄功能失调
A. 过悲
B. 过恐
C. 过怒
D. 过喜
E. 过思

正确答案：C。过怒

解析：心在志为喜为惊，过喜或过惊则伤心（D错）；肝在志为怒，过怒则伤肝（C对）；脾在志为思，过度思虑则伤脾（E错）；肺在志为悲为忧，过悲则伤肺（A错）；肾在志为恐，过恐则伤肾（B错）。